双歧三联活菌制剂说明书标明“冷处”贮存，其贮存条件是指
A. 温度不超过20℃
B. 温度10℃～30℃
C. 温度不超过20℃且遮光
D. 温度不超过-5℃且避光
E. 温度在2℃～10℃之间

正确答案：E。温度在2℃～10℃之间

解析：本题考查药品的贮存。双歧三联活菌制剂说明书标明“冷处”贮存，其贮存条件是指温度在2℃～10℃之间（E对）。药品贮存温度、光照及湿度是影响药品质量的重要因素，标明“阴凉处”贮存则应贮存在不超过20℃的环境中（A错）。标明在“凉暗处”贮存则贮存温度不超过20℃并遮光保存（C错）。标明在冷处贮存则应贮存在2℃～10℃环境中。一般药品贮存于室温10℃～30℃（B错）即可。